患者，男，58岁。头晕目眩，肢体麻木，足膝关节疼痛，舌质红，苔薄黄，脉弦滑。用药宜首选
A. 钩藤
B. 全蝎
C. 地龙
D. 天麻
E. 石决明

正确答案：D。天麻

解析：头晕目眩，舌红，苔薄黄，脉弦滑，为肝阳上亢的表现；肢体麻木，足膝关节疼痛，为风痹，用平抑肝阳，祛风通络的天麻治疗最宜（C对）。钩藤的功效（A错）是熄风止痉，清肝平肝，疏风散热。全蝎的功效（B错）是熄风镇痉，攻毒散结，通络止痛。地龙的功效（C错）是清热定惊，通经活络，平喘，利水。石决明（E错）是平肝潜阳，清肝明目。